因抑制神经元微管形成，从而引起周围神经病变的药物是
A. 利血平
B. 长春新碱
C. 异烟肼
D. 茶碱
E. 氯丙嗪

正确答案：B。长春新碱

解析：本题考查药物对机体各系统的毒性作用。因抑制神经元微管形成，从而引起周围神经病变的药物是长春新碱（B对）；长春新碱可以与微管蛋白结合，抑制微管蛋白的亚单位形成微管，导致轴突运输的障碍，从而引起周围神经病；利血平（A错）主要因干扰递质储存，耗竭去甲肾上腺素和多巴胺递质而导致精神抑郁；异烟肼（C错）会对中枢和外周神经系统产生毒性作用；茶碱（D错）常引起中枢兴奋；氯丙嗪（E错）可阻断黑质-纹状体通路的多巴胺受体，产生锥体外系功能障碍。